《医疗机构临床用血管理办法》规定，需要中级以上资格医师提出申请，科室主任核准签发，且医务部门批准的用血量限定范围是
A. ≤500ml
B. ＜800ml
C. ＜1000ml
D. ≥1600ml
E. ≤2000ml

正确答案：D。≥1600ml

解析：《医疗机构临床用血管理办法》规定，同一患者一天申请备血量达到或超过1600ml的，由具有中级以上专业技术职务任职资格的医师提出申请，科室主任核准签发后，报医务部门批准，方可备血。掌握“医疗机构临床用血管理、及法律责任”知识点。